男性，30岁。烦渴多饮多尿2个月。尿量每天8000ml，禁饮水7小时血渗透压305m0sm/（kg·H₂O），尿量110ml/h，尿渗透压250m0sm/（kg·H₂O），尿比重1.006。皮下注射垂体后叶素3mg后，第2小时尿量25ml，尿渗透压480m0sm/（kg·H₂O），尿比重1.012。诊断为完全性中枢性尿崩症，首选的处理是
A. 嘱限制饮水量
B. 去氨加压素治疗
C. 鞍区MRI检查
D. 垂体功能检查
E. 测定血清电解质水平

正确答案：B。去氨加压素治疗

解析：中年男性患者，诊断为完全性中枢性尿崩症，首选的处理是去氨加压素治疗（B对）。嘱限制饮水量（A错）为一般处理。鞍区MRI检查（C错）、垂体功能检查（D错）适用于尿崩症诊断确定之后明确病因。测定血清电解质水平（E错）无法确诊完全性中枢性尿崩症。